女，35岁。体检超声提示胆囊内强回声团，直径0.5cm，后伴声影，随体位改变而移动。既往无右上腹疼痛、发热及黄疸等症状。血常规正常，血糖正常。该患者适当的处理是
A. 体外震波碎石
B. 给予利胆排石药物
C. 腹腔镜胆囊切除术
D. 观察随诊
E. 胆囊切开取石

正确答案：D。观察随诊

解析：中年女性患者超声提示胆囊内强回声团，直径0.5cm（结石直径﹤3cm），随体位改变，可以诊断为胆囊结石。患者既往无右上腹疼痛、发热及黄疸等症状，血常规、血糖正常（无并发症的胆囊炎），无并发症的胆囊结石多采取观察随诊（D对）的策略，待病人出现症状时，采取相应的治疗措施。体外震波碎石（A错），给予利胆排石药物（B错），腹腔镜胆囊切除术（C错）和胆囊切开取石（E错）都是适用于有症状或并发症的胆囊结石。